血府逐瘀口服液是临床常用的成药，其处方组成的君药是
A. 桃仁、红花
B. 桃仁、赤芍
C. 川芎、红花
D. 桔梗、川芎
E. 赤芍、当归

正确答案：A。桃仁、红花

解析：本题考查的是血府逐瘀口服液的方义简释。血府逐瘀口服液是临床常用的成药，其处方组成的君药是桃仁、红花（A对）。血府逐瘀口服液：【方义简释】方中桃仁或炒桃仁，苦泄甘润，平而少偏，善破血行瘀；红花辛散温通，善活血通经、散瘀止痛。两药相须为用，活血化瘀力强，恰中病的，故为君药。地黄甘滋质润，苦寒清泄，善滋阴凉血清热，以除瘀热；川芎（CD错）辛香行散温通，善行气活血、祛风止痛；赤芍（BE错）苦能泄散，微寒能清，善清热凉血、散瘀止痛；当归甘能补润，辛散温通，善补血活血行瘀；牛膝苦泄降，酸入肝，甘补渗，善逐瘀通经、引血下行。五药相合，既助君药活血化瘀、止痛，又滋养阴血使活血祛瘀而不伤正，故为臣药。柴胡辛散苦泄微寒，善疏肝解郁、升举清阳；桔梗苦泄辛散而平，善宣散肺气，以利“宽中理气”，并载药上行；枳壳苦辛泄降，炒后趋平，善理气宽中。三药相合，能升降上焦之气机而宽胸行气，气行则血行，瘀散则痛止，故为佐药。甘草甘补和缓，平而偏凉，既清热、缓急止痛，又调和诸药，故为佐使药。全方配伍，苦辛泄散，共奏活血祛瘀，行气止痛之功，故善治气滞血瘀所致的胸痹、头痛日久。